女，52岁。肝炎肝硬化10年，近3个月腹围明显增大，1周来少尿，AFP及血常规正常。最可能的情况是
A. 肝病合并慢性肾炎
B. 急性肾小管坏死
C. 肾前性氮质血症
D. 肝肾综合征
E. 慢性肾小球肾炎

正确答案：D。肝肾综合征

解析：中年女性患者，肝炎肝硬化10年，近3个月腹围明显增大（提示腹水增多，肝功能恶化），1周来少尿（出现肾脏功能性病变），最有可能的情况是肝肾综合征（D对）。肝肾综合征是肝硬化常见的并发症，患者常合并有腹水，由于严重门静脉高压，导致体循环血流量减少及多种内源性扩血管物质不能被肝脏灭活，引起体循环血管床扩张，肾脏血流尤其是肾皮质灌注不足，出现肾功能衰竭，即少尿、无尿、氮质血症的表现。慢性肾小球肾炎（P478）（E错）简称慢性肾炎（A错），多见于中青年男性，以蛋白尿、血尿、高血压、水肿为基本临床表现；急性肾小管坏死（P512）（B错）主要表现为进行性氮质血症，水、电解质和酸碱平衡失调；肾前性氮质血症（九版诊断学P343-P344）（C错）是因全身血流量减少、肾灌注不足引起的以少尿、氮质血症为主要表现的综合征。